心与脾的功能失调，最易影响
A. 心神的潜藏
B. 精血的互化
C. 血液的生成
D. 血液的循行
E. 气血的转化

正确答案：C、D。血液的生成；血液的循行

解析：本题考查的是心与脾的关系。心与脾的功能失调，最易影响血液的生成（C对）与血液的循行（D对）。心与脾的关系，主要表现在血液的生成和运行两方面。心神的潜藏（A错）易受心与肝功能失调的影响。心与肝的关系主要表现在血液与神志方面的依存与协同。精血的互化（B错）易受肝与肾功能失调的影响。肝与肾的关系，称“肝肾同源”或“乙癸同源”（以天干配五行，肝属乙木，肾属癸水，故称），主要表现于精血同源、藏泄互用及阴阳互资等方面。气血的转化（E错）易受心与肺功能失调的影响。心与肺的关系，主要表现在心主血与肺主气、心主行血与肺主呼吸之间的关系。